对映异构体中一个有活性，一个无活性的手性药物是
A. 氯苯那敏
B. 普罗帕酮
C. 扎考必利
D. 氯胺酮
E. 氨己烯酸

正确答案：E。氨己烯酸

解析：本题考查药物的手性结构对药物活性的影响。对映异构体中一个有活性，一个无活性的手性药物是氨已烯酸（E对）。氨已烯酸只有S-对映体是GABA转氨酶抑制剂。两个对映体有相似的药理活性，但作用强度有明显的差异。例如抗过敏药氯苯那敏（A错），其右旋体的活性高于左旋体。手性药物的两个对映体之间的药理作用和强度以及与消旋体之间没有明显差异，属于静态手性类药物。如对普罗帕酮（B错）抗心律失常的作用而言，其两个对映体的作用是一致的。抗精神病药扎考必利（C错）对映异构体之间产生相反的活性。扎考必利通过作用于5-HT₃受体而起效的，其中R-对映体为5-HT₃受体阻断剂，S-对映体为5-HT₃受体激动剂。氯胺酮（D错）一种对映体具有药理活性，另一对映体具有毒性作用。氯胺酮为中枢性麻醉药物，只有R-（+）-对映体才具有麻醉作用，而S-（-）-对映体则产生中枢兴奋作用。